下列哪项与尿的生成过程无关
A. 肾小球的滤过
B. 肾小管与集合管的重吸收
C. 肾小管与集合管的排泄
D. 肾小管与集合管的分泌
E. 输尿管的蠕动

正确答案：E。输尿管的蠕动